牙外伤脱落多久内接受治疗，再植成功的几率越大
A. 1h
B. 30min
C. 40min
D. 50min
E. 60min

正确答案：B。30min

解析：牙离开口腔的时间越短，再植成功的几率越大，最好在30分钟内接受治疗。对于牙外伤的防护，提倡儿童在运动时使用保护牙托。保护牙托配戴在牙上、在脸部和头部受到击打时可起到保护牙的作用，通常用硅胶等高分子材料制成。掌握“学龄儿童口腔保健”知识点。